消化性溃疡的主要症状为
A. 食欲缺乏、消瘦
B. 恶心、呕吐
C. 嗳气、反酸
D. 呕血、黑便
E. 上腹疼痛

正确答案：E。上腹疼痛